世界卫生组织编订，其英文缩写为INN的是
A. 通用名
B. 国际非专有药名
C. 化学名
D. 商品名
E. 习用名

正确答案：B。国际非专有药名

解析：本题考查药物的名称。世界卫生组织编订，其英文缩写为INN的是国际非专有药名（B对）。药品通用名（A错）也称为国际非专利药品名称（INN），是世界卫生组织（WHO）推荐使用的名称。化学名（C错）是根据药品的化学成分确定的化学学术名称。药品的商品名（D错）是指经国家药品监督管理部门批准的特定企业使用的该药品专用的商品名称。习用名（E错）指药品习惯用名。